能用于治疗室上性快速性心律失常的药物有
A. 普萘洛尔
B. 维拉帕米
C. 腺苷
D. 奎尼丁
E. 普鲁卡因胺

正确答案：A、B、C、D、E。普萘洛尔；维拉帕米；腺苷；奎尼丁；普鲁卡因胺

解析：本题考查普萘洛尔。能用于治疗室上性快速性心律失常的药物有普萘洛尔（A对）、维拉帕米（B对）、腺苷（C对）、奎尼丁（D对）和普鲁卡因胺（E对）。普萘洛尔通过阻断β受体，减轻由β受体介导的心律失常。维拉帕米通过抑制钙离子内流，延长窦房结和房室结有效不应期，减慢窦房结的自律性和房室结的传导。腺苷能够减慢房室传导。奎尼丁和普鲁卡因胺均为钠离子通道阻滞剂，为广谱的抗心律失常药。